初孕妇，30岁。妊娠38周，因胸闷、憋气、不能平卧3日后入院。检查：血压120/80mmHg，脉搏110次/min，呼吸22次/min。心尖部闻及3/6级收缩期杂音。半卧位时颈静脉轻度怒张，双肺底闻及湿啰音。本例最可能的诊断是
A. 肺炎
B. 围生期心肌病
C. 妊娠期高血压疾病
D. 心脏病伴心力衰竭
E. 妊娠期高血压疾病性心脏病

正确答案：B。围生期心肌病